某女，87岁，患乏力倦怠、直肠脱垂数年，近日又见时而自汗不已。证属气虚下陷、肌表不固，治当补气升阳，固表止汗，宜选用的药是
A. 山药
B. 黄芪
C. 大枣
D. 红景天
E. 西洋参

正确答案：B。黄芪

解析：本题考查的是黄芪的功效。患乏力倦怠、直肠脱垂数年，近日又见时而自汗不已。证属气虚下陷、肌表不固，治当补气升阳，固表止汗，宜选用的药是黄芪（B对）。黄芪：【功效】补气升阳，益卫固表，托毒生肌，利水消肿。山药（A错）：【功效】益气养阴，补脾肺肾，固精止带。大枣（C错）：【功效】补中益气，养血安神，缓和药性。红景天（D错）：【功效】益气，平喘，活血通脉。西洋参（E错）：【功效】补气养阴，清热生津。